关于分子结构中引入羟基的说法，错误的是
A. 可以增加药物分子的水溶性
B. 可以增加药物分子的解离度
C. 可以与受体发生氢键结合，增强与受体的结合能力
D. 可以增加药物分子的亲脂性
E. 在脂肪链上引入羟基，可以减弱药物分子的毒性

正确答案：D。可以增加药物分子的亲脂性

解析：本题考查药物结构中的取代基对生物活性影响。分子结构中引入羟基可以减小药物分子的亲脂性（D错，为本题正确答案）。药物分子中的羟基一方面增加药物分子的水溶性（A对），从而增加药物分子的解离度（B对）。另一方面可能会与受体发生氢键结合，增强与受体的结合力（C对），改变生物活性。在脂肪链上引入羟基取代，常使活性和毒性下降（E对）。取代在芳环上的羟基，会使分子解离度增加，也会有利于和受体的碱性基团结合，使活性和毒性均增强。有时为了减少药物的解离度，便于吸收，或为了减缓药物的代谢速度、减低毒性，将羟基进行酰化成酯或烃化成醚，但其活性多降低。